毛细血管基底膜可形成钉状突起，见于
A. 弥漫性毛细血管内增生性肾小球肾炎
B. 弥漫性膜性增生性肾小球肾炎
C. 弥漫性膜性肾小球肾炎
D. 轻微病变性肾小球肾炎
E. 弥漫性新月体性肾小球肾炎

正确答案：C。弥漫性膜性肾小球肾炎

解析：弥漫性膜性肾小球肾炎（C对）的病变特征是肾小球毛细血管壁弥漫性增厚，肾小球基膜上皮细胞侧出现含免疫球蛋白的电子致密沉积物，沉积物之间基膜样物质增多，形成钉状突起（C对）。弥漫性毛细血管内增生性肾小球肾炎（急性肾炎）（A错）的病变特征是内皮细胞和系膜细胞增生，脏层上皮细胞和肾小球基膜之间有驼峰状沉积物（P266）。弥漫性膜性增生性肾小球肾炎（B错）的病变特征是肾小球基底膜增厚、系膜细胞增生和系膜基质增多，增生的系膜细胞突起插入毛细血管袢，形成双轨状（P271）。轻微病变性肾小球肾炎（D错）（P270）的病变特征是肾小球脏层上皮细胞足突消失。弥漫性新月体性肾小球肾炎（E错）的病变特征是新月体形成（P267）。